局限型侵袭性牙周炎的临床特点不包括
A. 牙周组织破坏程度与局部刺激物的量不成比例
B. 累及除切牙和第一磨牙以外的恒牙至少3颗
C. 第一磨牙近远中均有垂直型骨吸收则形成“弧形吸收”
D. 家族聚集性
E. 病变进展快，早期可出现牙齿松动

正确答案：B。累及除切牙和第一磨牙以外的恒牙至少3颗

解析：B项为广泛型侵袭性牙周炎的特点。局限型侵袭性牙周炎的特征是“局限于第一恒磨牙或切牙的邻面有附着丧失，至少波及两个恒牙，其中一个为第一磨牙。其他患牙（非第一磨牙和切牙）不超过两个”。掌握“侵袭性牙周炎”知识点。